女，65岁。右侧胸部闭合性损伤2天。右胸疼痛，咳嗽时加重，无呼吸困难。胸壁皮肤无破损，局部皮下淤血。胸部X线片示右侧第6肋骨单处骨折，右侧气胸压缩15%。最恰当的治疗措施是
A. 开胸探查
B. 胸壁切开，肋骨内固定
C. 胸壁包扎固定、镇痛
D. 胸腔闭式引流
E. 静脉滴注抗生素

正确答案：C。胸壁包扎固定、镇痛

解析：患者第6肋骨单处骨折，右侧气胸压缩15%。闭合性单处肋骨骨折最恰当的治疗措施是胸壁包扎固定、镇痛（C对）。气胸发生缓慢且积气量少的病人，勿需特殊处理，胸腔内的积气一般可在1-2周内自行吸收。大量气胸需进行胸膜腔穿刺，或行闭式胸腔引流术（D错），排除积气，促使肺尽早膨胀。